影响固体药物氧化的因素有
A. 温度
B. 离子强度
C. 溶剂
D. 光线
E. pH值

正确答案：A、D。温度；光线

解析：本题考查影响药物制剂稳定性的因素。影响固体药物氧化的因素有温度（A对）和光线（D对）。氧化是药物降解最常见的反应之一。一般来说，温度升高，反应速度加快。根据Van't Hoff规则，温度每升高10℃，反应速度约增加2～4倍。温度越高，药物降解速度越快。光是一种辐射能，光线的波长越短，能量越大，光线提供的能量可激发氧化反应，加速药物的降解。溶液pH值（E错）主要影响药物的水解，对固体药物氧化影响不大。溶剂（C错）对药物稳定性的影响比较复杂，其对药物的水解影响较大。液体制剂降解受溶剂的影响，溶剂的影响与固体药物无关。离子强度（B错）表达了溶液中离子的电性强弱的程度，与固体药物氧化无关。